氯丙嗪的锥体外系反应不包括
A. 体位性低血压
B. 迟发性运动障碍
C. 肌肉震颤、流涎
D. 急性肌张力障碍
E. 静坐不能

正确答案：A。体位性低血压

解析：锥体外系反应：长期大量服用氯丙嗪可出现三种反应：①帕金森综合征；②静坐不能；③急性肌张力障碍。掌握“氯丙嗪”知识点。